根及根茎类药材，在产地加工时需除去外皮的有
A. 白芍
B. 人参
C. 天南星
D. 郁金
E. 山药

正确答案：A、C、E。白芍；天南星；山药

解析：本题考查的是去除非药用部位的方法及适用的品种。根及根茎类药材，在产地加工时需除去外皮的有白芍（A对）、天南星（C对）、山药（E对）。根、根茎、块茎或鳞茎类中药一般多在产地趁鲜去皮。三棱、大黄、山药、千年健、天南星、天花粉、白及、白附子、半夏、粉葛、浙贝母等均需刮净或撞去外皮；天冬、北沙参、白芍等置沸水中煮或蒸后，除去外皮。